《中国药典》采用符号cm⁻¹表示的计量单位名称是
A. 长度
B. 体积
C. 波数
D. 黏度
E. 密度

正确答案：C。波数

解析：本题考查红外吸收光谱。《中国药典》采用符号cm⁻¹表示的计量单位名称是波数（C对）。红外吸收光谱中，波数的单位常用厘米的倒数（cm⁻¹）表示。